炎热夏季的某一天，气压很低，强烈阳光照射着交通繁忙的城市，一些居民突然出现了不同程度的眼睛红肿、流泪、咽痛、喘息、咳嗽、呼吸困难、头痛、胸闷等症状，导致出现这些症状可能的原因
A. CO急性中毒
B. 煤烟型烟雾
C. 光化学烟雾
D. 附近火山喷发烟雾
E. 某种传染病流行

正确答案：C。光化学烟雾

解析：炎热夏季的某一天，气压很低（汽车尾气难以扩散），强烈阳光照射（太阳紫外线强烈）着交通繁忙（汽车排放大量尾气）的城市，一些居民突然出现了不同程度的眼睛红肿、流泪、咽痛、喘息、咳嗽、呼吸困难、头痛、胸闷等症状（符合光化学烟雾事件受害者症状），综上，导致出现这些症状可能的原因是光化学烟雾（C对）（八年制第二版预防医学P16）。CO急性中毒（A错）由吸入CO过多所致，如煤气中毒，主要表现为CO与血液中红细胞的血红蛋白结合，形成稳定的COHb，使血红蛋白氧解离曲线左移，血氧不易释放而造成的细胞缺氧相关症状，本题未提及相关因素，且与题中居民症状不符，排除A选项（第八版内科学P907）。煤烟型烟雾（B错）主要由于燃煤产生的大量污染物排入大气，在不良气象条件下难以充分扩散，受害者异常反应主要为呼吸困难，胸闷、咳嗽、咽痛、呕吐等症状，本题未提及燃煤因素，且居民眼睛红肿、流泪症状也与煤烟型烟雾事件症状不符，排除B选项（八年制第二版预防医学P15-16）。附近火山喷发烟雾（D错）含有大量火山灰和火山气体，具有很强的刺激性和毒性，会对人群产生肺部伤害，出现呼吸道症状，当火山灰中的硫磺随雨而落产生酸雨时，会灼伤皮肤、眼睛和黏膜，本案例未提及火山因素，排除D选项。传染病流行（E错）必须具备三个基本条件即流行过程的三个环节，传染源、传播途径和易感人群，本案例缺少传染源，未提及传播途径，人群缺乏易感特征，排除E选项（P241）。